女，35岁。转移性右下腹疼痛5天，伴畏寒、发热2天。查体：T38.5℃，P90次/分，R21次/分。双肺呼吸音清，未闻及干湿性啰音，心律齐，全腹肌紧张，有明显压痛和反跳痛，麦氏点压痛明显，肠鸣音消失，腹腔穿刺抽出脓性液体，细菌培养结果最有可能为
A. 大肠埃希菌
B. 溶血性链球菌
C. 铜绿假单胞菌
D. 金黄色葡萄球菌
E. 变形杆菌

正确答案：A。大肠埃希菌

解析：患者转移性右下腹疼痛，畏寒、发热，全腹肌紧张，有明显压痛和反跳痛，麦氏点压痛明显（阑尾炎特有体征），肠鸣音消失，提示阑尾炎（P372）。腹腔穿刺抽出脓性液体，提示阑尾炎症扩散至腹腔，引发继发性腹膜炎，细菌培养结果最有可能为大肠埃希菌（A对）。